固定桥桥体与固位体之间的连接部分称
A. 桥体
B. 固位体
C. 连接体
D. 基牙
E. 人工牙

正确答案：C。连接体

解析：连接体：是固定桥桥体与固位体之间的连接部分。掌握“固定桥的组成和分类”知识点。